患者，男，48岁。上腹部无规律胀痛3年余，常因饮食不当而发作，偶有反酸，暧气，心血管检查无异常。应首先考虑的是
A. 慢性胆囊炎
B. 心绞痛
C. 胃溃疡
D. 胃癌
E. 慢性胃炎

正确答案：E。慢性胃炎

解析：患者中年男性，上腹部无规律胀痛3年余，常因饮食不当而发作，偶有反酸，暧气，心血管检查无异常，患者临床表现与慢性胃炎相符，故患者最可能的诊断为慢性胃炎（E对）。慢性胆囊炎（人卫八版外科学P459）（A错）患者常有胆绞痛病史，病人常在饱餐、进食油腻食物后出现腹胀、腹痛。心绞痛（P228）（B错）主要表现为与运动有关的胸骨后濒死样疼痛，休息或舌下含服硝酸甘油可缓解。胃溃疡（P370）（C错）主要表现为餐后上腹痛，腹痛有规律。胃癌（P376）（D错）主要表现为上腹痛、餐后加重、纳差、厌食、乏力及体重减轻。